功能性月经失调促进排卵的最好方法有
A. 人工周期疗法
B. 雌激素周期治疗
C. 氯底酚胺治疗
D. 黄体生成素释放激素
E. 刮宫

正确答案：C。氯底酚胺治疗

解析：功血时，为了促排卵，最常用的药物就是氯米芬（氯底酚胺，是最常用的促排卵药物)。掌握“功能失调性子宫出血”知识点。